与“气虚”关系最密切的两个脏是
A. 心与肺
B. 肺与脾
C. 心与肾
D. 肝与肾
E. 肝与肺

正确答案：B。肺与脾

解析：本题考查的是肺与脾的关系。与“气虚”关系最密切的两个脏是肺与脾（B对）。肺与脾的关系，主要表现在气的生成和津液的输布代谢两个方面。1.气的生成：肺所吸入的清气和脾运化而生成的水谷精气，是组成宗气的主要物质。因此，肺的呼吸功能和脾的运化功能是否强健，与气的盛衰密切相关。2.津液输布代谢：肺主宣发肃降，通调水道；脾主运化水液，输布津液。肺的宣发肃降和通调水道功能，有助于脾的运化水液功能，从而防止内湿的产生；而脾转输津液，散精于肺，则不仅是肺通调水道的前提，而且亦为肺的生理活动提供了必要的营养。因此，二者之间在津液的输布代谢中存在着相互为用的关系。心与肺（A错）的关系，主要表现在心主血与肺主气、心主行血与肺主呼吸之间的关系。肺主气，具有助心行血之作用。肺气正常则是血液正常循行的必要条件。心主血，推动血液循行，方能维持肺呼吸功能的正常进行，故有“呼出心与肺”之说。联结心之搏动和肺之呼吸两者之间的中心环节是积于胸中的“宗气”。由于宗气具有贯心脉而行气血，走息道而司呼吸的生理功能，从而加强了血液循环与呼吸运动之间的相互联系，以及在病变上的相互影响。心与肾（C错）的关系，主要表现在心肾阴阳水火既济与心血肾精之间的依存关系。1.心肾相交：心在五行属火，位居于上而属阳；肾在五行属水，位居于下而属阴。在正常情况下，心火必须下降于肾，助肾阳以温肾水，使肾水不寒；肾水必须上济于心，滋心阴以濡心阳，使心火不亢，如此维持心肾阴阳水火协调平衡，称“心肾相交”，又称“水火既济”。2.精血互生：心主血，肾藏精，血化为精，精能生血，这种精血互生关系，体现了心肾之间的相关性。肝与肾（D错）的关系，称“肝肾同源”或“乙癸同源”（以天干配五行，肝属乙木，肾属癸水，故称），主要表现于精血同源、藏泄互用及阴阳互资等方面。1.精血同源：肝藏血，肾藏精。血的化生，有赖于肾中精气的气化；肾中精气的充盛，亦有赖于血液的滋养。精血同源于水谷精微，又互生互化，称为“精血同源”。2.藏泄互用：肝气疏泄可使肾气开合有度，肾气闭藏可防止精气妄泻。疏泄与封藏相反相成，从而调节女子的排卵、月经来潮和男子的排精功能。3.阴阳互资：肝属木，肾属水，水能生木。肾阴滋养肝阴，共同制约肝阳，则肝阳不亢；肾阳资助肝阳，共同温煦肝脉，可防肝脉寒滞。肾阴不足常可引起肝阴不足，阴不制阳而导致肝阳上亢，称为“水不涵木”；例如，肝阴不足，亦可导致肾阴亏虚，从而导致相火上亢。另外，肝火太盛亦可下劫肾阴，从而形成肾阴不足病证。肝与肺（E错）的关系，主要表现于气机的调节。肺主降而肝主升，二者相互协调，对于全身气机的调畅是一个重要的环节。若肝升太过，或肺降不及，则多致气火上逆，可出现咳逆上气、甚则咯血等病变表现，称之为“肝火犯肺”。